阿片受体拮抗药是
A. 吲哚美辛
B. 塞来昔布
C. 哌替啶
D. 纳洛酮
E. 喷它佐辛

正确答案：D。纳洛酮

解析：本题考查μ受体的激动药。纳洛酮（D对）属于阿片类受体拮抗药，用于解救阿片类受体激动药中毒；哌替啶（C错）属于阿片类受体完全激动剂；喷它佐辛（E错）属于阿片受体部分激动剂；吲哚美辛（A错）、塞来昔布（B错）属于芳酸类非甾体抗炎药。